口腔医疗保健中易感染的疾病有
A. HIV感染与AIDS病
B. 乙型肝炎
C. 梅毒
D. 结核
E. 以上都易感染

正确答案：E。以上都易感染

解析：口腔环境是口腔医疗保健中潜在的病原体来源，包括血源性疾病、口腔疾病、系统性疾病的口腔病损及呼吸道疾病。如人类免疫缺陷病毒疾病、病毒性肝炎、结核、人疱疹病毒、梅毒等。掌握“口腔医疗保健中的感染”知识点。